进行膳食调查的主要目的是
A. 了解有无膳食缺乏症
B. 了解膳食组成及营养素摄取情况
C. 了解机体营养情况
D. 了解当地平均生活水平
E. 了解体内的营养素水平

正确答案：B。了解膳食组成及营养素摄取情况

解析：膳食调查属于营养调查的一部分，通过了解被调查对象在一定时间内通过膳食摄取的能量、各种营养素的数量和质量，据此来评价个体或群体的膳食数量和质量，以及评价被调查对象能量和营养素需求获得满足的程度（B对）。了解体内的营养素水平是膳食调查的其中一个目的，描述不够全面（E错）。营养缺乏症的发生通过人体营养水平的生化检验来发现（A错）。了解机体营养情况最好的方法是人体测量资料分析（C错）。了解当地平均生活水平是营养调查的目的之一（D错）。